患者腹痛肠鸣，泻下粪便臭如败卵，但泻而不爽，脘腹胀满，舌苔白厚而腐，脉滑。治疗应首选
A. 保和丸
B. 藿香正气散
C. 葛根芩连汤
D. 参苓白术汤
E. 龙胆泻肝汤

正确答案：A。保和丸

解析：宿食内停，阻滞肠胃，故腹痛肠鸣；浊腐下注，故泻下粪便臭如败卵；食滞日久，脾虚生湿化热，湿热内蕴，故见泻而不爽；脘腹胀满，舌苔白厚而腐，脉滑，均为食滞肠胃之征；治宜消食导滞，用保和丸加减（A对）。藿香正气散（B错）用于寒湿泄泻。葛根芩连汤（C错）用于湿热泄泻。脾虚泄泻用参苓白术散（D错）。肝气乘脾用龙胆泻肝汤（E错）。